下列哪项属于药性升浮药物的功效是
A. 止咳平喘
B. 渗湿利尿
C. 熄风潜阳
D. 祛风散寒
E. 清热泻下

正确答案：D。祛风散寒

解析：升浮药，其性属温热，味属辛、甘、淡，质地多为轻清至虚之品，作用趋向多主上升，向外，故而能够祛风散寒（D对）。沉降药，其性属寒凉，味属酸、苦、咸，质地多为重着坚实之品，作用趋向多主下行向内。就其代表药物的功效是而言，分别具有止咳平喘（A错）、渗湿利尿（B错）、熄风潜阳（C错）、清热泻下（E错）、平肝潜阳、重镇安神、收敛止血、止呕等作用。